以下属于外源性感染的是
A. 急性患者
B. 慢性患者
C. 带菌者
D. 带菌动物
E. 以上说法均正确

正确答案：E。以上说法均正确

解析：外源性感染指来自宿主体外细菌的感染，包括急性或慢性患者，带菌者以及病畜和带菌动物，均可向外环境排出病原菌。掌握“宿主的抗菌免疫及感染的发生发展”知识点。